用于评价表面活性剂的参数
A. pKₐ
B. ED₅₀
C. LD₅₀
D. LgP
E. HLB

正确答案：E。HLB

解析：本题考查药代动力学参数。用于评价表面活性剂的参数是HLB（E对）。亲水亲油平衡值（HLB）为表面活性剂分子中亲水亲油基团对油或水的综合亲和力；pKₐ（A错）为特定的平衡常数，代表一种酸离解氢离子的能力；半数有效量是指引起50%阳性反应或50%最大效应的浓度或剂量，分别用半数有效量（ED₅₀）（B错）及半数有效浓度（EC₅₀）表示；半数致死量（LD₅₀）（C错）是用于评价药物急性中毒的参数；LgP（D错）用于评价药物脂溶性。